患者，男，54岁。拟行膝关节置换术，围手术期宜选用的预防用抗菌药物
A. 头孢曲松
B. 头孢唑林
C. 头孢噻肟
D. 头孢他啶
E. 头孢吡肟

正确答案：B。头孢唑林

解析：本题考查抗菌药物。围手术期宜选用的预防用抗菌药物头孢唑林（B对）。头孢曲松（A错）是第三代头孢菌素类，临床应用上主要用于敏感致病菌所致的感染。头孢噻肟（C错）为第三代半合成头孢菌素，抗菌谱比头孢呋肟更广，对革兰阴性菌的作用更强，但对阳性球菌不如第一代与第二代头孢菌素。头孢他啶（D错）属第三代头孢菌素，对革兰阳性菌虽有一定的抗菌毒性，但较第一、二代弱。头孢吡肟（E错）为第四代头孢菌素，对革兰阴性菌和革兰阳性菌有强烈的杀菌作用，对耐药肠杆菌某些菌株敏感。